时间依赖型抗菌药物，药物浓度大于MIC的时间百分比（%T≥MIC）是预测临床疗效的常用PK/PD参数。碳青霉烯类药物%T≥MIC的临床疗效靶值范围是
A. ≥50%～75%
B. ≥45%～100%
C. ≥80%
D. ≥40%～50%
E. ≥60%～70%

正确答案：A。≥50%～75%

解析：本题考查碳青霉烯类药物的PK/PD参数。碳青霉烯类药物%T≥MIC的临床疗效靶值范围是≥50%～75%（A对）。